病毒性心肌炎痰瘀阻络证的用方是
A. 银翘散
B. 附子汤
C. 葛根芩连汤
D. 炙甘草汤合生脉散
E. 瓜蒌薤白半夏汤合失笑散

正确答案：E。瓜蒌薤白半夏汤合失笑散

解析：本证第十版虽然已删除，但不难选出正确选项，瓜蒌薤白半夏汤合失笑散（E对）用于痰淤阻络证以豁痰化瘀，宁心通络。银翘散（A错）用于热毒侵心证以清热解毒，宁心安神。附子汤在第十版书中已将附子汤（B错）换成参附养荣汤用以益气温阳，滋阴通脉，若阳虚浮肿者，加车前子，猪苓，茯苓等利水消肿。葛根芩连汤（C错）合甘露消毒丹加减用于湿毒犯心证以解毒化湿，宁心安神。炙甘草汤合生脉散（D错）适用于气阴两虚证以益气养阴，宁心安神。